阿尼林是下列的哪种物质
A. 苯
B. 多氯联苯
C. 苯胺
D. 联苯胺
E. 硝基苯

正确答案：C。苯胺

解析：本题考查苯胺的概念。苯胺（C对ABDE错），又称阿尼林、氨基苯等。化学式C₆H₅NH₂，分子量93.1。纯品为无色油状液体，易挥发，具有特殊气味，久置颜色可变为棕色。苯胺微溶于水，能溶于苯、乙醇、乙醚，氯仿等有机溶剂。